风湿性疾病中以唾液腺炎症为主要病理改变的疾病是
A. ANCA相关血管炎
B. 系统性硬化症
C. 系统性红斑狼疮
D. 类风湿关节炎
E. 干燥综合征

正确答案：E。干燥综合征

解析：干燥综合征主要累及外分泌腺体，以唾液腺和泪腺为代表，表现为腺体导管扩张、狭窄及腺体间质大量淋巴细胞浸润、小唾液腺上皮细胞破坏和萎缩（P829），因此以唾液腺炎症为主要病理改变的疾病是干燥综合征（E对）。